杜仲降血压的有效成分主要是
A. 松酯醇二葡萄糖苷
B. 谷甾醇
C. 杜仲胶
D. 白桦脂醇
E. 京尼平苷

正确答案：A。松酯醇二葡萄糖苷

解析：本题考查的是杜仲的有效成分。杜仲降血压的有效成分主要是松酯醇二葡萄糖苷（A对）。杜仲【成分】含杜仲胶（C错），为一种硬质橡胶。另含桃叶珊瑚苷、松酯醇二葡萄糖苷（降压成分）、β-谷甾醇（B错）、白桦脂醇（D错）等。杜仲胶含量因树龄和厚薄不同而不同，陈杜仲约含20%，厚杜仲皮为14.32%，薄杜仲皮为11.4%，老细枝约18.10%，干嫩枝4.67%。此外，尚含树脂、鞣质、还原糖等。